体温在39℃以上，一日内波动范围超过2℃者，多见于
A. 风湿热
B. 伤寒
C. 疟疾
D. 大叶性肺炎
E. 中暑

正确答案：A。风湿热

解析：体温在39℃以上，一日内波动范围超过2℃者，为弛张热，又称败血症热型，常见于风湿热（A对）、败血症、重症肺结核及化脓性炎症等。伤寒（B错）、大叶性肺炎（D错）表现为稽留热。疟疾（C错）表现为间歇热。中暑（E错）属于体温调节中枢功能失常。